C-3位含有氨基甲酸酯基团的药物是
A. 头孢氨苄
B. 头孢克洛
C. 头孢呋辛
D. 硫酸头孢匹罗
E. 头孢曲松

正确答案：C。头孢呋辛

解析：本题考查头孢菌素类抗菌药。头孢呋辛（C对）的C-3位为氨基甲酸酯。头孢氨苄（A错）C-3位为甲基。头孢克洛（B错）C-3位取代为氯原子。头孢匹罗（D错）含季铵基团。头孢曲松（E错）的C-3位取代为杂环。